因干扰Na⁺通道而对心脏产生不良反应的药物是
A. 多柔比星
B. 索他洛尔
C. 普鲁卡因胺
D. 肾上腺素
E. 强心苷

正确答案：C。普鲁卡因胺

解析：本题考查普鲁卡因胺。因干扰Na⁺通道而对心脏产生不良反应的药物是普鲁卡因胺（C对）；多柔比星（A错）可能通过氧自由基的途径对心脏产生毒性；索他洛尔（B错）和溴苄胺等，能够阻断与复极化过程有关的K⁺通道，抑制K⁺外流，或增加内向电流如Na⁺和Ca²⁺内流；肾上腺素（D错）可激动心脏β₁受体，使心肌收缩力加强，心肌耗氧量显著增加，导致心脏氧气的供应相对不足，具有诱发心绞痛的潜在毒性；强心苷（E错）抑制心肌细胞膜上的Na⁺，K⁺-ATP酶，增加心肌细胞内游离Ca²⁺浓度，从而增强心肌收缩力，可能导致各种心律失常。